女性，20岁，因低热、腹痛诊断为结核性腹膜炎。近日来呕吐、腹胀，未解大便。查体：肠鸣音亢进。最可能的并发症是
A. 肠梗阻
B. 肠穿孔
C. 中毒性肠麻痹
D. 肠出血
E. 腹腔脓肿

正确答案：A。肠梗阻

解析：青年女性患者，既往有结核性腹膜炎病史。近日出现呕吐、腹胀、未解大便（排气排便停止），符合肠梗阻的症状（九版外科学P360）。查体：肠鸣音亢进（见于机械性肠梗阻）。综合该患者病史和查体，考虑诊断为粘连引起的机械性肠梗阻（A对）。肠穿孔（B错）表现为腹部压痛、反跳痛、肌紧张及肠鸣音消失等腹膜炎征象。中毒性肠麻痹（C错）是由细菌和病毒等引起胃肠功能紊乱，肠鸣音减弱或消失。肠出血（P450）（D错）可表现为呕血与黑粪，大量失血可有头晕、心慌、乏力等失血性周围循环衰竭的表现。腹腔脓肿（九版外科学P333）（E错）常有发热，在脓肿部位可有持续性的钝痛，无呕吐、腹胀表现。